男，32岁，反复腰部胀痛1年余。B超见右肾盂结石，大小1.5cm×1.0cm，左肾积水，左输尿管上段结石，大小1.0cm×0.8cm。尿常规：RBC5～10/HP，WBC16～20/HP。总肾功能正常。首选的治疗方法是
A. 左输尿管结石体外冲击波碎石
B. 右肾盂结石体外冲击波碎石
C. 左输尿管切开取石
D. 药物排石
E. 右肾盂切开取石

正确答案：A。左输尿管结石体外冲击波碎石

解析：患者右侧肾盂结石，左侧输尿管上段结石、左肾积水，对于一侧肾结石、对侧输尿管结石者，应先处理左侧输尿管结石，以解除梗阻、缓解左侧肾积水症状。患者左侧输尿管结石大小为1.0cm×0.8cm，对于直径≤2cm的肾结石及输尿管上段结石首选体外冲击波碎石（ESWL），故该患者首选的治疗方法是左输尿管结石体外冲击波碎石（A对）。右侧肾盂结石（B错）体积较小，对患者影响不大，可先不予处理。输尿管切开取石术（C错）适用于嵌顿较久或其他方法治疗无效的结石。药物排石（D错）主要用于直径＜0.6cm、表面光滑、结石以下尿路无梗阻的患者。肾盂切开取石（E错）主要用于肾盂输尿管处梗阻并肾盂结石的患者，可在取石的同时解除梗阻。